左旋多巴的药理作用包括
A. 增强免疫
B. 引起轻度直立性低血压
C. 抗震颤麻痹
D. 减少催乳素分泌
E. 引起短暂心动过速

正确答案：B、C、E。引起轻度直立性低血压；抗震颤麻痹；引起短暂心动过速